光刀手术的创口，拆线时间应是
A. 术后3天
B. 术后5天
C. 术后7天
D. 术后14天
E. 术后20天

正确答案：D。术后14天

解析：本题考查创口的拆线时间。光刀手术的创口，拆线时间应是术后14天（D对）。术后5天（B错）可为面部的清洁创口开始拆线，张力过大或有手术特殊要求者除外。术后7天（C错）可将颈部缝线拆除。术后3天（A错）为死腔过大或渗出物较多时，应延长引流到的时间。术后20天（E错）时间过久，不符合光刀手术最佳拆线时间。